有效成分遇热不稳定的中药，适宜的提取方法是
A. 冷浸法
B. 连续回流提取法
C. 煎煮法
D. 水蒸气蒸馏法
E. 升华法

正确答案：A。冷浸法

解析：本题考查的是浸渍法。有效成分遇热不稳定的中药，适宜的提取方法是浸渍法（A对）。浸渍法：本法适用于有效成分遇热不稳定的或含大量淀粉、树胶、果胶、黏液质的中药的提取。但本法出膏率低，需要特别注意的是当水为溶剂时，其提取液易于发霉变质，需注意加入适当的防腐剂。连续回流提取法（B错）：本法弥补了回流提取法中溶剂消耗量大，操作麻烦的不足，实验室常用索氏提取器来完成本法操作、但此法耗时较长。煎煮法（C错）：此法简便，但含挥发性成分或有效成分遇热易分解的中药材不宜用此法。水蒸气蒸馏法（D错）：适用于具有挥发性的、能随水蒸气蒸馏而不被破坏，且难溶或不溶于水的化学成分的提取。此类化合物的沸点多在100℃以上，并在100℃左右有一定的蒸气压。升华法（E错）：固体物质在受热时不经过熔融直接转化为气体状态，该气体遇冷后又凝结成固体的现象称为升华。中药中有一些成分具有升华的性质，能利用升华法直接从中药中提取出来。如樟木中的樟脑，茶叶中的咖啡因等。